统计表的基本原则，叙述错误的是
A. 重点突出，简单明了
B. 一张表包括一个中心内容
C. 主谓分明，层次清楚
D. 标目安排合理
E. 计算精准，数据无误

正确答案：E。计算精准，数据无误

解析：统计表的基本原则，一是重点突出，简单明了，即一张表包括一个中心内容；二是主谓分明，层次清楚，即标目安排合理。掌握“统计表和统计图”知识点。